在人的心理健康中起着核心作用的是
A. 正常的智力
B. 良好的情绪
C. 和谐的人际关系
D. 适应变化的社会环境
E. 人格的完整

正确答案：B。良好的情绪

解析：情绪在人的心理健康中起着核心的作用。心理健康者能经常保持愉快、开朗、自信的心情，善于从生活中寻求乐趣，对生活充满希望。掌握“心理健康概述”知识点。